关于浸膏剂与流浸膏剂的叙述，正确的是
A. 流浸膏剂与浸膏剂制备时所用溶剂均为不同浓度的乙醇
B. 流浸膏剂的浓度为每1ml相当于原药材19，而浸膏剂每1ml相当于原药材2～59
C. 流浸膏剂与浸膏剂的成品均应测定含醇量
D. 除另有规定外，渗漉法制备流浸膏时应先收集药材量85%的初漉液另器保存
E. 浸膏剂的含水量约为5%

正确答案：D。除另有规定外，渗漉法制备流浸膏时应先收集药材量85%的初漉液另器保存